下述关于血磷的描述哪项不正确
A. 正常血磷浓度波动于0.8~1.3mmol/L
B. 甲状腺素是调节磷代谢的主要激素
C. 磷主要由小肠吸收，由肾排出
D. 肾功能衰竭常引起高磷血症
E. 高磷血症是肾性骨营养不良的主要发病因素

正确答案：B。甲状腺素是调节磷代谢的主要激素

解析：正常血磷浓度波动于0.8~1.3mmol/L（A对），主要由空肠吸收，从肾排出（C对），受状旁腺激素、1,25-(OH)2D3和降钙素三种激素（B错，为本题正确答案）共同调节。肾衰时肾小球滤过率降低，肾排磷减少导致高磷血症（D对）。高磷血症可抑制肾脏1α-羟化酶，使1,25-(OH)2D3生成减少，从而诱发肾性骨营养不良（E对）。